主动安乐死与被动安乐死的区别在于
A. 前者是安乐死对象主动要求；后者是其被动要求
B. 前者是安乐死对象的家属主动要求；后者是其被动要求
C. 前者是负责医生主动要求；后者是其被动要求
D. 前者是医生采取促死手段使安乐死对象安然死去；后者是医生停止抢救甚至放弃一切治疗，任安乐死对象自然死去
E. 前者是安乐死对象自己采取促死手段致死；后者是其自己停止一切治疗，被动等死

正确答案：D。前者是医生采取促死手段使安乐死对象安然死去；后者是医生停止抢救甚至放弃一切治疗，任安乐死对象自然死去